取粉末加乙醇1～2滴及30%硝酸1滴，放置片刻，镜检，有黄色针状或针簇状结晶析出的药材是
A. 白芍
B. 黄连
C. 白芷
D. 巴戟天
E. 附子

正确答案：B。黄连

解析：本题考查的是黄连的成分。取粉末加乙醇1～2滴及30%硝酸1滴，放置片刻，镜检，有黄色针状或针簇状结晶析出的药材是黄连（B对）。黄连的有效成分主要是生物碱，已经分离出来的生物碱有小檗碱（含量最高）、巴马汀、黄连碱、甲基黄连碱、药根碱和木兰碱（属于阿朴菲型）等；大多属苄基异喹啉类衍生物，季铵型生物碱。《中国药典》以小檗碱为指标成分进行含量测定。以盐酸小檗碱计，要求味连含小檗碱不得少于5.5%，表小檗碱不得少于0.80%，黄连碱不得少于1.6%，巴马汀不得少于1.5%；要求雅连含小檗碱不得少于4.5%；要求云连含小檗碱不得少于7.0%。白芍（A错）、白芷（C错）、巴戟天（D错）与附子（E错）不含小檗碱。